治疗大头瘟毒，头面红肿，咽喉不利，宜首选
A. 穿心莲
B. 板蓝根
C. 金银花
D. 山豆根
E. 蒲公英

正确答案：B。板蓝根

解析：大头瘟毒，乃感受风热疫毒之邪，壅于上焦，发于头面，所以导致头面红肿，治以清热解毒，消肿；咽喉不利为温毒壅滞咽喉，治以凉血利咽。板蓝根苦寒，有清热解毒，凉血消肿利咽之功，主治多种瘟疫热毒之证，可用治丹毒、痄腮、大头瘟疫，头面红肿，咽喉不利者（B对）。穿心莲具有清热解毒，凉血，消肿，燥湿的功效，温热之邪引起的病症皆可治疗，并且可用治火热毒邪诸证，没有利咽的功效（A错）。金银花具有清热解毒，疏散风热的功效，可治疗外感风热或温病初起，身热头痛，咽痛口渴，为一切内痈外痈之要药，没有利咽的功效（C错）。山豆根具有清热解毒，利咽消肿的功效，为治疗咽喉肿痛的要药，偏于治疗热毒蕴结之咽喉肿痛，而疏散风热疫毒之邪、治疗大头瘟毒之力较板蓝根弱（D错）。蒲公英具有清热解毒，消肿散结，利湿通淋的功效，为清热解毒，消痈散结之佳品，是治疗乳痈之要药，没有利咽的功效（E错）。